某70岁女患者，因尿路感染于10天前开始服用氨苄青霉素。现出现腹泻。取便标本，培养出大量革兰阳性葡萄球菌。试问腹泻发生机制是
A. 菌群失调
B. 肠毒素使腺苷环化酶活性增加
C. 细菌侵袭肠黏膜所致
D. 内毒素作用于肠黏膜
E. 肠蠕动加快

正确答案：A。菌群失调

解析：在应用抗生素治疗感染性疾病的过程中，导致宿主某部位寄居细菌的种群发生改变或各种群的数量比例发生大幅度变化从而导致疾病称为菌群失调。菌群失调可表现为二重感染或重叠感染。引起二重感染的常见细菌有葡萄球菌、白假丝酵母菌等。现认为肠道菌群失调症后引起的假膜性结肠炎主要由艰难梭菌所致，金葡菌仅为伴随菌。掌握“细菌的分类”知识点。